气管颈段
A. 上端邻甲状软骨下缘
B. 第2~4气管软骨环前方有甲状腺峡
C. 下端邻气管杈
D. 两侧邻膈神经和迷走神经
E. 后邻咽的喉咽部

正确答案：B。第2~4气管软骨环前方有甲状腺峡

解析：第2~4气管软骨环前方有甲状腺峡（B对）。气管上端邻环状软骨下缘（A错）。气管颈部下端是胸廓上口（C错）。